三七皂苷属于
A. 四环三萜皂苷
B. 五环三萜皂苷
C. 甾体皂苷
D. 强心苷
E. 氰苷

正确答案：A。四环三萜皂苷

解析：本题考查的是三七皂苷的分类。三七皂苷属于四环三萜皂苷（A对）。三七中主要化学成分是三萜皂苷类，含量高达12%。《中国药典》以人参皂苷Rg₁、人参皂苷Rb₁及三七皂苷R₁为指标成分进行含量测定，要求三者总量不得少于5.0%。三萜：基本骨架由6个异戊二烯单位组成。三萜的种类很多，但以皂苷形式存在的三萜类型并不多，较为常见的有羊毛甾烷型、达玛烷型、齐墩果烷型、乌苏烷型和羽扇豆烷型，其中前两种属于四环三萜，后三种则属于五环三萜。1.四环三萜（A错）：结构与甾醇很类似。主要有以下类型。（1）羊毛甾烷型，如猪苓酸A。（2）达玛烷型，如20（S）-原人参二醇。2.五环三萜（B错）：主要有以下类型。（1）齐墩果烷型，此类以齐墩果酸最为多见。（2）乌苏烷型，此类大多是乌苏酸的衍生物。（3）羽扇豆烷型，如羽扇豆种子中存在的羽扇豆醇，酸枣仁中分得的白桦醇和白桦酸等。甾体皂苷（C错）分类主要有螺旋甾烷醇类、异螺旋甾烷醇类、呋甾烷醇类和变形螺旋甾烷醇类。强心苷（D错）由强心苷元与糖缩合而成。天然存在的强心苷元是C₁₇侧链为不饱和内酯环的甾体化合物。氰苷（E错）主要指一类α-羟腈的苷，属于氧苷的一种。如苦杏仁苷等。